用人单位应当实施由（）的职业病危害因素日常监测，并确保监测系统处于正常运行状态
A. 兼职工人
B. 单位职工
C. 专人负责

正确答案：C。专人负责

解析：本题考查职业病危害因素日常监测。职业健康监护工作过程中，要求有一支具有一定经验、精通本专业知识、熟悉相关学科知识的相对高学历人员组成的专业技术人员队伍。同时应由指定机构依照法规进行专门监督、指导，并制定一套完整的切实可行的管理模式。用人单位应设立专门机构或专人管理（C对AB错）职业健康监护工作，将职业健康监护工作由专门机构或专人依照法律、法规的要求确定监督对象、管理范围和监督职责。